注射用美洛西林/舒巴坦，规格1.25g（美洛西林1.0g，舒巴坦0.25g）。成人静脉符合单室模型。美洛西林表观分布容积V=0.5L/Kg。关于复方制剂美洛西林钠与舒巴坦的说法，正确的是
A. 美洛西林为“自杀性”β-内酰胺酶抑制剂
B. 舒巴坦是氨苄西林经改造而来，抗菌作用强
C. 舒巴坦可增强美洛西林对β－内酰胺酶稳定性
D. 美洛西林具有甲氧肟基，对β-内酰胺酶具有高稳定作用
E. 舒巴坦属于碳青霉烯类抗生素

正确答案：C。舒巴坦可增强美洛西林对β－内酰胺酶稳定性

解析：本题考查舒巴坦。舒巴坦为青霉烷砜类抗生素（E错），为不可逆竞争性β-内酰胺酶抑制剂。与β-内酰胺类抗生素合用，能增强青霉素类及头孢类药物对β-内酰胺酶的稳定性（C对）。克拉维酸为“自杀性”β-内酰胺酶抑制剂（A错）。在氨苄西林侧链的氨基上引入极性较大的咪唑啉酮酸基团得到美洛西林，以扩大抗菌谱，具有抗假单胞菌酶活性（D错）。